采用提净法炮制的药材是
A. 半夏
B. 六神曲
C. 麦芽
D. 巴豆
E. 芒硝

正确答案：E。芒硝

解析：本题考查的是提净法。采用提净法炮制的药材是芒硝（E对）。提净法：指某些矿物药，特别是一些可溶性无机盐类药物，经过溶解，过滤，除净杂质后，再进行重结晶，以进一步纯净药物的方法。提净的目的：①使药物纯净，提高疗效。②缓和药性。③降低毒性。采用提净法炮制的中药有芒硝、硇砂等。半夏（A错）常用复制法炮制。复制法是将净选后的药物加入一种或数种辅料，按规定操作程序，反复炮制的方法。复制的主要目的：①降低或消除药物的毒性或刺激性，如半夏等。②改变药性，如天南星等。③增强疗效，如白附子等。④矫臭矫味，如紫河车等。六神曲（B错）常用发酵法炮制。发酵法指经净制或处理后的药物，在一定的温度和湿度条件下，利用霉菌和酶的催化分解作用，使药物发泡、生衣的方法。发酵的主要目的：①改变原有性能，产生新的治疗作用，扩大药用品种，如六神曲、建神曲、淡豆豉等。②增强疗效。如半夏曲。麦芽（C错）常用发芽法炮制。发芽法是将净选后的新鲜成熟的果实或种子，在一定的温度或湿度条件下，促使萌发幼芽的方法。发芽的主要目的是：通过发芽，淀粉被分解为糊精、葡萄糖及果糖，蛋白质被分解成氨基酸，脂肪被分解成甘油和脂肪酸，并产生各种消化酶、维生素，使其具有新的功效，扩大用药品种。巴豆（D错）常用制霜法炮制。制霜法是指药物经过去油制成松散粉末或析出细小结晶或升华的方法。制霜法根据操作方法的不同分为去油制霜、渗析制霜、升华制霜等。去油制霜的目的：①降低毒性，缓和药性。如巴豆。②降低副作用。如柏子仁。渗析制霜的目的是制造新药，扩大用药品种，增强疗效。如西瓜霜。升华制霜的目的是纯净药物，如砒霜。